未经患者或其家属同意，对患者进行实验性治疗的，由卫生行政部门给予的处理是
A. 暂停执业活动3～6个月
B. 暂停执业活动六个月至一年
C. 给予行政处分
D. 吊销医师执业证书
E. 追究刑事贵任

正确答案：B。暂停执业活动六个月至一年

解析：未经患者或其家属同意，对患者进行实验性治疗的，由卫生行政部门给予警告或者责令暂停6个月以上1年以下执业活动（B对）。题干中并未说明造成严重后果或构成犯罪的，因而不构成吊销医师执业证书或追究刑事责任的处罚（DE错）。